用于缓解心肌缺血和减轻心绞痛症状，在胃肠道吸收完全，无肝脏首过效应，生物利用度近100%,普通片剂作用持续3～6小时的药物是
A. 美托洛尔
B. 单硝酸异山梨酯
C. 瑞舒伐他汀
D. 福辛普利
E. 硝酸甘油

正确答案：B。单硝酸异山梨酯

解析：本题考查首过效应。单硝酸异山梨酯（B对）有片剂和缓释剂型，在胃肠道吸收完全，无肝脏首关效应。